下列哪一项不属于贫血者的禁忌职业环境
A. 氰化物
B. 铅
C. 苯
D. TNT粉尘

正确答案：A。氰化物

解析：本题考查贫血相关禁忌症。铅中毒（B对）、苯中毒（C对）、TNT粉尘（D对）（三硝基甲苯）均可引起血液系统的疾病，导致贫血等血液系统疾病病情加重，因此要贫血作为职业禁忌证严格遵守。氰化氢（A错，为本题正确答案）的禁忌证为硫代硫酸钠过敏者、严重甲状腺、肾脏等慢性疾病及精神抑郁者。